组成药物中含有连翘的方剂.是
A. 温胆汤
B. 凉膈散
C. 清骨散
D. 温脾汤
E. 清胃散

正确答案：B。凉膈散

解析：凉膈散（B对）组成为大黄、厚朴、甘草、山栀子、薄荷、黄芩、连翘、竹叶、蜜（凉膈硝黄栀子翘，黄芩甘草薄荷饶，竹叶蜜煎疗膈上，中焦燥实服之消）；温胆汤（A错）组成为半夏、竹茹、枳实、陈皮、甘草、茯苓；清骨散（C错）组成为银柴胡、胡黄连、秦艽、鳖甲、地骨皮、青蒿、知母、甘草；温脾汤（D错）组成为当归、干姜、附子、人参、芒硝、大黄、甘草；清胃散（E错）组成为生地黄、当归、牡丹皮、黄连、升麻。